PEG类可用作
A. 软膏基质
B. 肠溶衣材料
C. 栓剂基质
D. 包衣增塑剂
E. 片剂润滑剂

正确答案：A、C、D、E。软膏基质；栓剂基质；包衣增塑剂；片剂润滑剂

解析：本题考查乳膏剂的基质与附加剂。固体PEG与液体PEG适当比例混合可得半固体的软膏基质（A对）。PEG可作为栓剂的水溶性基质（C对），为难溶性药物的常用载体。增塑剂可改变高分子薄膜的物理机械性质，使其更具柔韧性。甘油、丙二醇、聚乙二醇等可作某些纤维素衣材的增塑剂（D对）。PEG4000、PEG6000具有良好的润滑效果，可作为片剂的润滑剂（E对）。肠溶衣材料（B错）常用醋酸纤维素酞酸酯（CAP）、聚乙烯醇酞酸酯（PVAP）、甲基丙烯酸共聚物、、醋酸纤维素苯三酸酯（CAT）、羟丙甲纤维素酞酸醋（HPMCP）、丙烯酸树脂EuS100、EuL100等。